器官供体和器官受体是同一个人，称为
A. 自体移植
B. 同质移植
C. 同种移植
D. 异种移植
E. 交互移植

正确答案：A。自体移植

解析：若器官供体和器官受体是同一个人，则称自体移植。掌握“人体器官移植伦理”知识点。